以下哪项不属于多形性低度恶性腺癌的结构
A. 小叶状结构
B. 筛状结构
C. 腺泡样结构
D. 条索状结构
E. 乳头或乳头囊状结构

正确答案：C。腺泡样结构

解析：多形性低度恶性腺癌明显的特征是不同病例或同一病例内组织结构的多形性，包括：小叶状结构、乳头或乳头囊状结构、筛状结构、条索状结构和小导管样结构。掌握“多形性低度恶性腺癌”知识点。